夜盲症可能是由于缺乏
A. 维生素A
B. 维生素D
C. 维生素B₁
D. 维生素C
E. 维生素E

正确答案：A。维生素A